确诊伤寒的首选检查是
A. 尿培养
B. 血培养
C. 胆汁培养
D. 粪培弄
E. 骨髓培养

正确答案：B。血培养

解析：伤寒沙门菌的培养是伤寒诊断的“金标准”，其中首选检查是血培养（B对），骨髓培养（E错）对已经用抗菌药物治疗，血培养阴性者尤为适用。也可理解为早期以血培养为主，后期则可考虑做骨髓培养，有助于提高阳性率比。尿培养（A错）和粪培养（D错）可作为辅助诊断，特别是粪便培养对确定排菌状态很有帮助。胆汁培养（C错）不是伤寒的辅助实验室检查内容。